下列哪项不是普萘洛尔的作用
A. 内在拟交感活性
B. 抗血小板聚集作用
C. 降低眼内压作用
D. 减少肾素释放
E. 抑制脂肪分解

正确答案：A。内在拟交感活性

解析：普萘洛尔具有较强的β受体阻断作用，对β1和β2受体的选择性很低，没有内在拟交感活性。掌握“β肾上腺素受体阻断剂”知识点。